地塞米松的药理作用特点是
A. 无抗炎作用
B. 有弱抗炎作用和弱水盐代谢作用
C. 有强抗炎作用和弱水盐代谢作用
D. 有弱抗炎作用和强水盐代谢作用
E. 有抗炎作用但无水盐代谢作用

正确答案：C。有强抗炎作用和弱水盐代谢作用